以下不属于社会医学主要研究内容的是
A. 社会卫生策略
B. 社会卫生状况
C. 医学治疗技术
D. 影响人群健康的社会因素
E. 社会卫生措施

正确答案：C。医学治疗技术